a受体阻断药可翻转哪种药物的升压作用
A. 阿托品+毛果芸香碱
B. 阿托品+碘解磷定
C. 肾上腺素
D. 去甲肾上腺素
E. 色甘酸钠

正确答案：C。肾上腺素

解析：a受体阻断药能选择性地与a肾上腺素受体结合，其本身不激动或较弱激动肾上腺素受体，却能阻碍去甲肾上腺素能神经递质及肾上腺素受体激动药与a受体结合，从而产生抗肾上腺素作用。它们能将肾上腺素（C对）的升压作用翻转为降压作用，这个现象称为“肾上腺素作用的翻转”。阿托品（AB错）作用于心血管系统主要是减慢心率，但不伴随血压和心输出量的变化。去甲肾上腺素（D错）主要作用是升高血压。色甘酸钠（E错）主要用于治疗哮喘。